临终关怀的范围
A. 急诊患者
B. 重症患者
C. 晚期肿瘤患者
D. 慢性病患者
E. 危重症患者

正确答案：C。晚期肿瘤患者

解析：对于不可逆转的疾病终末期患者（包括其亲属），特别是难以取得积极治疗效果的晚期肿瘤患者等心身遭受痛苦折磨的患者，可给予临终关怀治疗（C对ABDE错）。